羚角钩藤汤证发热的特点是
A. 夜热早凉
B. 高热不退
C. 身热夜甚
D. 长期低热
E. 白天高热

正确答案：B。高热不退

解析：羚角钩藤汤的发热特点是高热不退。为温热病邪传入厥阴，肝经热盛，热极动风所致。肝经热盛，故高热不退（B对）。夜热早凉是青蒿鳖甲汤的发热特点（A错）。身热夜甚是清营汤的发热特点（C错）。